治疗脆弱拟杆菌所致吸入性肺脓肿首选的抗菌药物是
A. 万古霉素
B. 庆大霉素
C. 青霉素
D. 克林霉素
E. 红霉素

正确答案：D。克林霉素

解析：治疗脆弱拟杆菌所致吸入性肺脓肿首选的抗菌药物有三种：林可霉素、克林霉素（D对）和甲硝唑。万古霉素（A错）为耐甲氧西林金黄色葡萄球菌引起的肺炎首选用药。庆大霉素（B错）为氨基糖苷类抗生素，是肺炎克雷伯杆菌的首选用药。青霉素（C错）为肺炎球菌肺炎的首选用药。红霉素（E错）为支原体肺炎、军团菌肺炎的首选用药。